釉珠常位于
A. 根分叉内或附近
B. 牙本质上
C. 牙釉质上
D. 根尖
E. 根中1/3

正确答案：A。根分叉内或附近

解析：本题考查釉珠。釉珠常位于根分叉内或附近（A对）。釉珠的发生起因于一小团错位的成釉细胞或者由于上皮根鞘的一小团上皮异常分化，再度出现成釉功能而形成釉珠。釉珠大小似粟粒呈球形，多位于根分叉内或附近（A对DE错）。釉珠为牢固附着于牙骨质表面的釉质小块（BC错）。